规定列基本医疗保险基金不予支付的药品目录的是
A. 中药材
B. 中药饮片
C. 中成药
D. 血液制品（特殊适应症）
E. 果味制剂

正确答案：B。中药饮片

解析：本题考查城镇职工基本医疗保险用药范围管理。规定列基本医疗保险基金不予支付的药品目录的是中药饮片（B对）。《城镇职工基本医疗保险用药范围管理暂行办法》第五条规定，《药品目录》所列药品包括西药、中成药（含民族药，下同）、中药饮片（含民族药，下同）。西药和中成药列基本医疗保险基金准予支付的药品目录，药品名称采用通用名，并标明剂型。中药饮片列基本医疗保险基金不予支付的药品目录，药品名称采用药典名。